患者突然跌倒，神志不清，抽搐吐涎沫，两目上视，或伴有猪羊叫声，二便失禁，移时苏醒，舌苔白腻，脉弦滑。治疗首选方剂
A. 控涎丹
B. 导痰汤
C. 二阴煎
D. 定痫丸
E. 涤痰汤

正确答案：D。定痫丸

解析：癫痫阳痫其机理为肝风内动，痰随风动，风痰上扰，心神被蒙，故治法为急以开窍醒神，继以泻热涤痰息风，方药选用黄连解毒汤和定痫丸加减（D对）。控涎丹（A错）可以攻逐痰饮，用于治疗痰涎内伏证。导痰汤（B错）可以行气化痰，用于治疗厥证之痰厥。二阴煎（C错）可以清心泻火，养阴安神，用于治疗中风血不养筋，及疟疾汗多。涤痰汤（E错）可以豁痰开窍，用于治疗中风痰迷心窍，舌强不能言。